目前，我国卫生法规中所涉及的民事责任的主要承担方式是
A. 恢复原状
B. 赔偿损失
C. 停止侵害
D. 消除危险
E. 支付违约金

正确答案：B。赔偿损失

解析：我国卫生法规中所涉及的民事责任的主要承担方式是赔偿损失（B对），民事责任的承担方式还有停止侵害（C错）、排除障碍、消除危险（D错）、返还财产、恢复原状（A错）、修理、重做、更换、支付违约金（E错）、消除影响、恢复名誉、赔礼道歉。